荆芥的常用炮制方法是
A. 炒黄法
B. 炒焦法
C. 麸炒法
D. 炒炭法
E. 砂炒法

正确答案：D。炒炭法

解析：本题考查荆芥的炮制方法。荆芥的常用炮制方法是炒炭法（D对）。荆芥【炮制方法】处方用名有荆芥、荆芥炭。芥子【炮制方法】处方用名有芥子、白芥子、炒芥子、炒白芥子（A错）。山楂【炮制方法】处方用名有山楂、炒山楂、焦山楂（B错）、焦楂、山楂炭。麸炒（C错）的目的①增强疗效，如山药、白术、芡实等。②缓和药性，如苍术、枳实、薏苡仁等。③矫臭矫味，如僵蚕等。砂炒（E错）的目的①增强疗效，便于调剂和制剂，如狗脊、穿山甲等。②降低毒性，如马钱子等。③便于去毛，如骨碎补等。④矫臭矫味，如鸡内金等。